一过性脑功能障碍，昏迷时间在半小时以内，查体及辅助检查无异常发现，应诊断为
A. 脑震荡
B. 脑挫裂伤
C. 原发性脑干损伤
D. 急性硬脑膜外血肿
E. 慢性硬脑膜下血肿

正确答案：A。脑震荡

解析：一过性脑功能障碍，昏迷时间在半小时以内，查体及辅助检查无异常发现，应诊断为脑震荡（A对）。昏迷-清醒-再昏迷：常是颅内血肿，尤其是硬膜外血肿的典型症状（D错）。脑挫裂伤：伤后昏迷在半小时以上，并即刻出现局灶症状与体征，脑脊液呈血性改变，神经系统检查多有阳性体征，CT检查可见脑挫伤区有点片状高密度或高低混杂密度影像（B错）。原发性脑干损伤：伤后即刻出现显著的生命功能紊乱，眼球固定、瞳孔多变，高热不退，昏迷深且持久，但不伴有颅内压增高表现；若为中脑损伤则出现去大脑强直，表现为两上肢伸直、内收并内旋，两下肢挺直，头后仰，呈角弓反张状（C错）。慢性硬膜下血肿是指伤后三周以上颅内出血发生在硬脑膜下腔者，血肿增大后会产生占位效应，导致脑室和脑干受压，产生呕吐、意识障碍、头痛，颅内压增高为主，应及时CT确诊和果断手术干预，术后效果堪称满意。对于血肿的出血来源和发病机理尚无统一的认识，临床表现以呕吐、意识障碍、头痛，颅内压增高为主，部分有痴呆、淡漠和智力迟钝等精神症状，少数可有偏瘫、失语和局源性癫痫等局源性脑症状。本病表现为慢性过程，早期容易被忽视，应及时手术（E错）。